下列关于生物技术药物注射剂的说法，错误的是
A. 稳定性易受温度的影响
B. 稳定性易受pH的影响
C. 处方中加入蔗糖用作稳定剂
D. 处方中一般不得添加EDTA
E. 处方中加入聚山梨酯80防止蛋白变性

正确答案：D。处方中一般不得添加EDTA

解析：本题考查处方。注射剂处方中，除主药外，还可根据制备及医疗的需要添加其他物质，以增加注射剂的有效性、安全性与稳定性，EDTA（D错，为本题正确答案）等螯合剂能够抑制氧化。